下列关于种植体骨结合的相关叙述中，不恰当的说法是
A. 手术中应严格控制产热和散热
B. 种植体植入后，应立即进行修复治疗
C. 手术中应注意对骨组织的活力的保护
D. 养成良好的口腔卫生习惯
E. 种植体材料的生物相容性要好

正确答案：B。种植体植入后，应立即进行修复治疗

解析：本题考查牙种植术概论。种植体的早期负载：种植体植入后，应保证足够的骨愈合过程，待骨结合完成以后再作修复治疗（B错，为本题正确答案）。